可作为非水溶性基质滴丸剂冷凝液的是
A. 醋酸纤维素
B. 单硬脂酸甘油酯
C. 山梨醇
D. 液体石蜡
E. 水

正确答案：E。水

解析：本题考查滴丸剂的冷凝液。常用的冷凝液有非水溶性基质可用水（E对）、不同浓度的乙醇、酸性或碱性水溶液等；水溶性基质可用液状石蜡（D错）、植物油、甲基硅油等。醋酸纤维素（A错）为水不溶性高分子薄膜材料。单硬脂酸甘油酯（B错）可作为滴丸剂的脂溶性基质。山梨醇（C错）可作为软胶囊囊壁的增塑剂。